具有突发性剑突下钻顶样剧烈疼痛症状的疾病是
A. 胆囊结石
B. 胆管结石
C. 胆囊癌
D. 胆管癌
E. 胆道蛔虫

正确答案：E。胆道蛔虫

解析：具有突发性剑突下钻顶样剧烈疼痛症状的疾病是胆道蛔虫（E对）病。胆囊结石（A错）、胆管结石（B错）多为绞痛，而非钻顶样剧烈疼痛，胆囊癌（C错）、胆管癌（D错）多无疼痛。